吸入粉雾剂的特点有
A. 药物吸收迅速
B. 药物吸收后直接进入体循环
C. 无肝脏首过效应
D. 比胃肠给药的半衰期长
E. 比注射给药的顺应性好

正确答案：A、B、C、E。药物吸收迅速；药物吸收后直接进入体循环；无肝脏首过效应；比注射给药的顺应性好

解析：本题考查吸入粉雾剂的特点。吸入粉雾剂的特点有①无胃肠道降解作用；②无肝脏首过效应（C对）；③药物吸收迅速（A对），给药后起效快；④通过吸收促进剂或其它方法提高大分子药物的生物利用度；尤其适于多肽和蛋白质类药物；⑤小分子药物尤其适于呼吸道直接吸入或喷入给药；⑥药物吸收后直接进入体循环（B对），达到全身治疗目的；⑦用于胃肠道难以吸收的水溶性大的药物；⑧顺应性好（E对），特别适于需长期注射治疗的患者；使用不当容易引起呛咳。⑨局部作用的药物，给药剂量明显降低，毒副作用小。